麻醉药品和第一类精神药品处方资格，由哪个部门授予
A. 县级以上卫生行政主管部门
B. 省级卫生行政主管部门
C. 社区的市级人民政府卫生主管部门
D. 社区的市级人民政府药品监督管理部门
E. 执业医师所在的医疗机构

正确答案：E。执业医师所在的医疗机构

解析：医疗机构应当按照有关规定，对本机构执业医师和药师进行麻醉药品和精神药品使用知识和规范化管理的培训。执业医师经考核合格后取得麻醉药品和第一类精神药品的处方权，药师经考核合格后取得麻醉药品和第一类精神药品调剂资格。掌握“处方管理概述及一般规定、处方权”知识点。